在制剂稳定性研究中，t1/2的含义是
A. 药物含量下降50%所需要的时间
B. 药物的血药浓度下降50%所需要的时间
C. 药物在体内消耗50%所需要的时间
D. 药物含量降低10%所需要的时间
E. 药物含量下降到10%所需要的时间

正确答案：A。药物含量下降50%所需要的时间